不需要载体，一些物质在细胞膜由高浓度一侧向低浓度转运的过程是
A. 被动扩散
B. 主动转运
C. 促进扩散
D. 吞噬作用
E. 胞饮作用

正确答案：A。被动扩散

解析：本题考查药物的转运方式。被动扩散（A对）不需要载体，由高浓度一侧向低浓度转运；主动转运（B错）是物质逆浓度差或逆电位差的跨膜转运；促进扩散（C错）是膜蛋白介导的被动扩散；胞饮（E错）是细胞形成内吞囊泡汲取水溶性物质和液体的方式；吞噬（D错）是细胞内吞较大的固体颗粒物质。